在结构中引入手性吗琳环，水溶性增加、毒副作用较小，左旋体作用更强，故临床使用其左旋体的药物是
A. 环丙沙星
B. 洛美沙星
C. 依诺沙星
D. 莫西沙星
E. 氧氟沙星

正确答案：E。氧氟沙星

解析：本题考查喹诺酮类药物的性质和代谢。左氧氟沙星（E对）为将喹诺酮1位和8位成环得到含有手性吗啉环的药物，药用左旋体，左旋体的抗菌作用大于右旋异构体。